使用大鼠对一农药进行长期致癌试验，每组的动物数至少
A. 40只
B. 60只
C. 80只
D. 100只
E. 120只

正确答案：D。100只